固位体和桥体若与对（牙合）牙上的不同金属修复体接触则会引发
A. 继发性龋
B. 咬合早接触
C. 电位差刺激
D. 基牙受力过大
E. 牙周膜轻度损伤

正确答案：C。电位差刺激

解析：电位差刺激：固位体和桥体若与对（牙合）牙上的不同金属修复体接触，在唾液中产生的电位差或基牙牙体修复体与固位体不同金属产生的电位差，也可能引起基牙疼痛，此时需消除电位差，消除疼痛。掌握“固定桥修复后出现的问题及处理”知识点。